关于腹膜腔的叙述错误的是
A. 由脏、壁腹膜相互移行而成
B. 是一密闭的腔隙
C. 是一潜在性腔隙
D. 是一不规则的腔隙
E. 无

正确答案：B。是一密闭的腔隙

解析：腹膜腔是由脏、壁腹膜相互移行而成（A对），共同围成的一潜在性（C对）、不规则的（D对）腔隙。男性腹膜腔为密闭的腔隙;女性腹膜腔则借输卵管腹腔口,经输卵管、子宫、阴道与外界相通（B错，为本题正确答案）